患者，女，48岁。颈前肿物，生长迅速，质地较硬，轻度疼痛，表面不平，推之不动，声音嘶哑，随吞咽活动减弱，同位素扫描显示为冷结节。应首选的治疗措施是
A. 中药外敷
B. 中药内服
C. 中药内服、外敷
D. 内服、外敷、熏洗
E. 手术治疗

正确答案：E。手术治疗

解析：石瘿常见于颈前多年存在的肿块生长迅速，质地坚硬如石，表面凹凸不平，推之不移，并可出现吞咽时移动受限。若肿块压迫，引起喉头移位或侵犯喉部神经时，可引起呼吸或吞咽困难，甚或发生声音嘶哑。甲状腺同位素131碘扫描多显示为凉结节(或冷结节)。该患者的临床表现，辅助检查可诊断为石瘿。石瘿相当于西医的甲状腺癌，为恶性肿瘤，一旦确诊，宜早期手术切除（E对）。不宜耽搁，以免肿瘤转移。中药内服、外敷、熏洗可辅助治疗，但不应作为首选（ABCD错）。